建议普通人群每次刷牙时间至少为
A. 1分钟
B. 2分钟
C. 3分钟
D. 4分钟
E. 5分钟

正确答案：B。2分钟

解析：临床研究显示，人们在刷牙的初始2分钟内，牙菌斑去除量超过80%。2分钟后刷牙效率明显降低。所以，建议普通人群每次刷牙时间至少为2分钟。掌握“自我口腔保健方法”知识点。